依照《中华人民共和国药品管理法实施条例》，医疗机构配制的制剂可以在指定的医疗机构之间调剂使用的是
A. 发生灾情、疫情、突发事件
B. 临床急需而市场没有供应
C. 经国务院或省级药品监督管理部门批准
D. 医疗机构之间协议调剂使用
E. 在规定期限内

正确答案：A、B、C、E。发生灾情、疫情、突发事件；临床急需而市场没有供应；经国务院或省级药品监督管理部门批准；在规定期限内

解析：本题考查的是医疗机构制剂的调剂使用。依照《中华人民共和国药品管理法实施条例》，医疗机构配制的制剂可以在指定的医疗机构之间调剂使用的是发生灾情、疫情、突发事件（A对）；临床急需而市场没有供应（B对）；经国务院或省级药品监督管理部门批准（C对）；在规定期限内（E对）。医疗机构制剂的调剂使用：医疗机构制剂一般只能是本医院自用，不得调剂使用。在特殊情况下，经国务院或者省级药品监督管理部门批准，医疗机构配制的制剂可以在规定的期限内、在指定的医疗机构之间调剂使用（D错），其中的“特殊情况”是指：发生灾情、疫情、突发事件或者临床急需而市场没有供应时。在省内进行调剂是由省级药品监督管理部门批准；在各省之间进行调剂或者国务院药品监督管理部门规定的特殊制剂的调剂必须经国务院药品监督管理局批准。医疗机构制剂的调剂使用，不得超出规定的期限、数量和范围。取得制剂批准文号的医疗机构应当对调剂使用的医疗机构制剂的质量负责。接受调剂的医疗机构应当严格按照制剂的说明书使用制剂，并对超范围使用或者使用不当造成的不良后果承担责任。